毒性评价试验的基本目的不包括
A. 观察受试物毒作用的表现和性质
B. 毒作用机制和解毒药物研究
C. 剂量-反应研究
D. 确定毒作用的靶器官
E. 确定损害的可逆性

正确答案：B。毒作用机制和解毒药物研究